6个月女婴，人工喂养为主，体格检查发现血红蛋白（Hb）值偏低，应添加的辅食主要是
A. 肝泥
B. 蛋黄泥
C. 西红柿泥
D. 米粉
E. 苹果泥

正确答案：A。肝泥

解析：本题考查过渡期食物的选择。6个月的婴儿，人工喂养，Hb偏低，表明婴儿有贫血倾向。由于缺铁性贫血是我国最主要、最常见的贫血类型，所以喂养时应增加铁的供给。肝泥（A对BCDE错）含有丰富的铁且因为蛋黄泥含铁比肝泥铁含量低，且不易吸收，应予以添加肝泥。